心脾两虚的主要病症有
A. 心悸怔忡
B. 失眠多梦
C. 乏力食少
D. 腹胀便溏
E. 呕吐泛酸

正确答案：A、B、C、D。心悸怔忡；失眠多梦；乏力食少；腹胀便溏

解析：本题考查的是心脾两虚证的临床表现。心脾两虚的主要病症有心悸怔忡（A对）、失眠多梦（B对）、乏力食少（C对）与腹胀便溏（D对）。心脾两虚证的临床表现，常见心悸怔忡，失眠多梦，健忘，食纳减少，腹胀，大便溏泻，倦怠乏力，舌质淡嫩，脉细弱。呕吐泛酸（E错）为食滞胃脘证的临床表现。食滞胃脘证的临床表现，常见脘腹胀满，呕吐酸腐，嗳气反酸，或矢气酸臭，不思饮食，大便泄泻或秘结。舌苔厚腻，脉滑。